具有降转氨酶作用的是
A. 五味子
B. 厚朴
C. 二者皆是
D. 二者皆不是

正确答案：A。五味子

解析：本题考查的是中药药理学研究为中医辨证论治加特效药提供依据。具有降转氨酶作用的是五味子（A对）。中药药理学研究为中医辨证论治加特效药提供依据：如红曲具有抑制胆固醇合成，影响体内胆固醇和甘油三酯的代谢，抑制动脉粥样硬化及脂质在肝脏沉积的作用，功效与他汀类药物相似，但无明显的肝脏损害作用，因此，在中医治疗痰浊瘀阻型高脂血症的遣药组方过程中，红曲可作为必选中药。再如湿热瘀阻型肝炎患者的治疗中，五味子也是必选中药之一，因为其所含的五味子素具有降低转氨酶的作用。厚朴（B错）中主要化学成分为木脂素类化合物，包括厚朴酚以及和厚朴酚等，《中国药典》采用高效液相色谱法测定药材中厚朴酚与和厚朴酚含量，两者总含量不得少于2.0%。